心中静脉与什么动脉伴行
A. 右冠状动脉主干
B. 左冠状动脉主干
C. 后室间支
D. 前室间支
E. 左缘支

正确答案：C。后室间支

解析：心中静脉起于心尖部，与右冠状动脉的后室间支（C对）伴行。